甲状旁腺功能亢进症患者可产生
A. 低钙血症
B. 低磷血症
C. 两者均有
D. 两者均无
E. 无

正确答案：B。低磷血症

解析：甲状旁腺功能亢进PTH分泌增多，抑制近曲小管及远曲小管对磷的重吸收，尿磷排泄增加会引起低磷血症（B对）。因血液钙磷乘积为一常数，故血钙升高（A错）。